下列除哪项外，均可导致渴不多饮
A. 阴虚
B. 湿热
C. 寒湿
D. 痰饮
E. 瘀血

正确答案：C。寒湿

解析：寒湿之邪为阴邪，不伤津液，故口不渴，亦不欲饮（C错，为本题正确选项）。阴虚，因阴虚津液不足，不能上承于口，则口渴；体内无实热耗津，则不欲饮。故可见口干不欲饮且兼潮热、盗汗、颧红等症状（A对）。湿热，因湿热内困，津液气化障碍，不能上承于口，则口渴；内有湿邪，则不能多饮。故可见渴不多饮且兼见头身困重，身热不扬，脘闷苔腻（B对）。痰饮，因痰饮为阴邪，内停伤阳，津液不能化气上承，则口渴喜热饮，为津液输布障碍而非津液不足，故可见渴不多饮（D对）。瘀血，因瘀血内阻，气化不利，津液不能化气上承，则口干；亦属津液输布障碍，非津液真正亏乏。故口干，但欲漱水不欲咽，兼见舌质隐青或有青紫色瘀斑，脉涩（E对）。